通过激活一种抗凝血酶Ⅲ而发挥抗凝作用的药物是
A. 肝素
B. 维生素K
C. 阿司匹林
D. 链激酶
E. 华法林

正确答案：A。肝素

解析：本题考查肝素的作用。通过激活一种抗凝血酶Ⅲ而发挥抗凝作用的药物是肝素（A对）。维生素K（B错）是促凝血药。华法林（E错）能够竞争性抑制氢醌型维生素K合成，阻止凝血因子的合成而产生抗凝作用。阿司匹林（C错）是解热镇痛抗炎药。链激酶（D错）是血栓溶解药。